根据“诸寒之而热者取之阴”的治则，治宜
A. 热者寒之
B. 寒者热之
C. 壮水制火
D. 益火消阴
E. 以上都不是

正确答案：C。壮水制火

解析：“诸寒之而热者取之阴”是指用苦寒药治疗热证，而热不退，反见增重，这不是有余的热证，而是肾阴（真阴）不足的虚热，故治疗应滋阴补肾，即“壮水制火”（C对）。热者寒之即以寒治热，指用寒凉方药或具有寒凉功效的措施而治疗热性病证的治法。如表热证用辛凉解表方药，里热证用苦寒清里方药等（A错）。寒者热之即以热治寒，指用温热方药或具有温热功效的措施而治疗寒性病证的治法。如表寒证用辛温解表方药，里寒证用辛热温里方药等（B错）。对“阳虚则寒”所出现的虚寒证，治宜扶阳以抑阴，即王冰所谓“益火之源，以消阴翳”（D错）。